IP3受体位于
A. 质膜
B. 高尔基体
C. 内质网
D. 溶酶体
E. 核糖体

正确答案：C。内质网

解析：IP3受体是一种内质网通道蛋白，由四个相对分子质量为260kDa的糖蛋白组成的四聚体。四个亚基组成一个跨膜的通道，每个亚基都有IP3结合的部位，当3～4个部位被IP3占据时，受体复合物构象发生改变。掌握“各信号分子及转导机制”知识点。